小量阿司匹林预防血栓形成的机制是
A. 抑制磷脂酶
B. 抑制TXA2的合成
C. 减少PGI2的合成
D. 抑制凝血酶原
E. 减少花生四烯酸的合成

正确答案：B。抑制TXA2的合成

解析：低浓度阿司匹林能减少血小板中血栓素A2（TXA2）的生成，而影响血小板的聚集及抗血栓形成，达到抗凝作用。因此，临床上采用小剂量阿司匹林治疗缺血性心脏病、脑缺血病、房颤、人工心脏瓣膜、动静脉瘘或其他手术后的血栓形成。掌握“阿司匹林”知识点。